女，45岁。1天前进高脂，餐后出现右上腹剧烈绞痛，阵发性加剧，并向右肩背部放射，伴恶心、呕吐、发热，体温38℃。该患者最可能的诊断是
A. 肝脓肿
B. 胃溃疡穿孔
C. 急性肺栓塞
D. 急性胆囊炎
E. 急性胰腺炎

正确答案：D。急性胆囊炎

解析：患者中年女性，高脂饮食后右上腹绞痛、向右肩放射（急性胆囊炎典型症状），伴恶心呕吐和发热，根据患者临床表现，最可能的诊断是急性胆囊炎（D对）。肝脓肿（A错）常表现为寒战高热、肝区持续性疼痛和肝肿大，不会出现阵发性绞痛。胃溃疡穿孔（B错）多有溃疡病史，穿孔发生前常有溃疡加重、过度疲劳、精神紧张等诱因，表现为突发上腹刀割样疼痛。急性肺栓塞（C错）常有呼吸困难、胸痛、咯血三联征。急性胰腺炎（E错）疼痛多位于左上腹，向左肩放射。